简化口腔卫生指数（OHI-S）需要检查的牙面是
A. 21、11、31、41的唇（颊）面，36、46的舌面
B. 16、11、26、21的唇（颊）面，36、46的舌面
C. 16、11、26、31的唇（颊）面，36、46的舌面
D. 16、26、46、46的唇（颊）面，11、31的舌面
E. 16、11、26、31的唇（颊）面，21、41的舌面

正确答案：C。16、11、26、31的唇（颊）面，36、46的舌面

解析：简化口腔卫生指数（OHI-S）是Greene和Vermillion对他们在1964年提出的，它只检查6个牙面16、11、26、31的唇（颊）面，36、46的舌面。掌握“牙周病流行病学及分级预防”知识点。